对湿热敏感的药物需制备成临床快速起效的制剂，首选剂型是
A. 注射用无菌粉末
B. 口崩片
C. 注射液
D. 输液
E. 气雾剂

正确答案：A。注射用无菌粉末

解析：本题考查注射用无菌粉末。对湿热敏感的药物需制备成临床快速起效的制剂，首选剂型是注射用无菌粉末（A对）。注射用无菌粉末在临用前需经灭菌注射用水或生理盐水等溶解后才可注射，主要适用于水中不稳定药物，尤其是对湿热敏感的抗生素和生物制品。口腔崩解片又称为口崩片（B错），系指在口腔内不需要用水即能迅速崩解或溶解的片剂。一般由直接压片和冷冻干燥法制备，由冷冻干燥法制备的口腔崩解片称口服冻干片。注射液（C错）系指原料药物或与适宜的辅料制成的供注入体内的无菌液体制剂。包括溶液型、乳状液型或混悬型等注射液。输液（D错）是指由静脉滴注输入体内的大剂量（除另有规定外，一般不小于100ml）注射液。它是注射液的一种给药形式，故也称大容量注射液，通常包装于玻璃或塑料的输液瓶或袋中，不含防腐剂或抑菌剂。气雾剂（E错）系指原料药物或原料药和附加剂与适宜的抛射剂共同装封于具有特制阀门系统的耐压容器中，使用时借助抛射剂的压力将内容物呈雾状物喷出，用于肺部吸入或直接喷至腔道黏膜及皮肤的制剂。